下列有关正常淋巴结的描述哪项正确
A. 直径多为0.2～0.5cm，质地韧，表面光滑
B. 与毗邻组织可有粘连
C. 有明显压痛
D. 质地柔软，表面光滑
E. 容易触及

正确答案：D。质地柔软，表面光滑

解析：淋巴结分布于全身，一般体格检查仅能检查身体各部表浅的淋巴结。正常情况下，淋巴结较小，直径多在0.2～0.5cm之间，质地柔软，表面光滑（D对A错），与临近组织无粘连（B错），不易触及（E错），亦无压痛（C错）。